男，45岁。低热干咳2周。经胸部X片诊断为浸润性肺结核。既往有高血压史5年，痛风史3年，口服药物治疗。在患者进行抗结核治疗时，应避免使用的药物是
A. 异烟肼
B. 利福平
C. 乙胺丁醇
D. 吡嗪酰胺
E. 链霉素

正确答案：D。吡嗪酰胺

解析：吡嗪酰胺的代谢产物吡嗪酸可促进肾小管对尿酸的重吸收，从而抑制尿酸的排泄，进而引起高尿酸血症。本例患者有痛风（体内尿酸代谢异常）史3年，故应避免使用的药物是吡嗪酰胺（D对）。乙胺丁醇也可引起高尿酸血症，但发生率较低，故痛风患者应慎用或禁用（C对）（故本题不严谨，CD均为正确答案）。异烟肼、利福平、链霉素可用于肺结核伴高血压、痛风的患者（ABE错）。常用抗结核药物主要不良反应归纳如下：异烟肼为周围神经炎、肝功能损害；利福平为肝功能损害、过敏反应；链霉素为听力障碍、眩晕、肾功能损害；吡嗪酰胺为肠胃不适、肝功能损害、高尿酸血症、关节痛；乙胺丁醇为视神经炎；对氨基水杨酸为胃肠不适、过敏反应、肝功能损害（P71表2-7-1 常用抗结核药物成人剂量和主要不良反应）。